机体发生创伤后，营养状况的评估指标中不包括的是
A. 血小板测定
B. 体重
C. 白蛋白测定
D. 皮褶厚度
E. 淋巴细胞测定

正确答案：A。血小板测定

解析：营养状况的评定是指通过临床检查、人体测量、生化检查等手段，判断机体营养状况，确定营养不良的类型和程度。其中，人体测量是应用最广泛的营养评价指标，包括体重（B对）、体重指数、皮褶厚度（D对）与臂围和握力测定。生化及实验室检查则包括白蛋白测定（C对）、氮平衡与净氮利用率、淋巴细胞测定（E对）等，但不包括血小板的测定（A错，为本题正确答案）。